后堤区的作用是
A. 基托后缘定位
B. 边缘封闭作用
C. 支持作用
D. 排牙标志
E. 缓冲作用

正确答案：B。边缘封闭作用

解析：本题考查后堤区的作用。后堤区位于上腭前后颤动线之间，上颌的全口义齿后缘应该止于后堤区，后堤区起边缘封闭的作用（B对）。上颌义齿基托后缘（A错）止于前后颤动线之间，腭小凹后2mm处，后堤区是一个宽约5mm的区域，不能作为基托后缘的定为标志。后堤区黏膜具有一定的弹性，无法提供义齿的支持作用（C错）。后堤区位于上腭后部，与排牙无关（D错）。上颌义齿基托后缘止于后堤区内，与基托的缓冲作用（E错）无关。